某医师欲采用横断面调查研究的方法，调查高血压病在人群中的分布情况，选择最合适的指标为
A. 病死率
B. 发病率
C. 死亡率
D. 患病率
E. 二代发病率

正确答案：D。患病率

解析：某医师采用横断面调查研究的方法，调查高血压病在人群中的分布情况，收集的是特定时间、特定人群中高血压病及有关因素的资料，所以能得到特定人群中患高血压病的人口比例，即患病率（D对），所以最合适的指标为患病率。病死率主要用于病程短且易引起死亡的疾病，多用于急性传染病（A错），反映疾病的严重程度和医疗、诊断水平，所以不适合作为调查高血压病在人群中的分布情况的指标。该医师采用横断面调查研究的方法，收集特定时间的资料并加以描述，不能获得一定期间内（一般为1年）高血压病新发病例出现的频率，也不能获得一定期间内（通常为1年）某人群中死于高血压病的频率，所以发病率（B错）和死亡率（C错）均不是合适的指标。二代发病率（续发率）用于比较传染病传染力的强弱（E错），分析传染病流行因素对传染病传播的影响，衡量日常生活接触传播在传染病流行中的作用，以及评价免疫接种、隔离、消毒等卫生防疫措施的效果，对于调查高血压病在人群中的分布情况并不合适。